散热量大，热源分散的高温车间的通风降温措施应首选
A. 全面自然通风
B. 有组织的全面自然通风
C. 全面机械通风
D. 局部机械通风
E. 喷雾风扇

正确答案：B。有组织的全面自然通风